治疗癥瘕痰湿证，应首选
A. 开郁二陈汤
B. 苍附导痰丸
C. 香棱丸
D. 桂枝茯苓丸
E. 血府逐瘀汤

正确答案：B。苍附导痰丸

解析：苍附导痰丸功效化痰除湿，活血消癥，治疗癥瘕痰湿瘀结证（B对）。香棱丸可活血化瘀，理气散结，消癥止痛，治疗癥瘕气滞证（C错）。桂枝茯苓丸功效活血化瘀，缓消癥块，治疗瘀阻胞宫证，妊娠胎动不安或漏下不止，产后恶露不尽而腹痛拒按者（D错）。血府逐瘀汤功效理气活血，祛瘀通经，使气血流畅，冲任瘀血消散，经闭得痛。多用于气滞血瘀证（E错）。